携带细菌绝大多数遗传信息，决定细菌基因型的是
A. 染色体
B. 质粒
C. 毒力岛
D. 转座因子
E. 前噬菌体

正确答案：A。染色体

解析：细菌的各种遗传特性主要受到细菌的质核中染色体环状双螺旋DNA所控制。掌握“细菌遗传变异的物质基础及机制”知识点。